常单生或2～3个基部连生，苞片外表面紫红色、内表面密被白色絮状茸毛的药材是
A. 丁香
B. 红花
C. 槐花
D. 款冬花
E. 金银花

正确答案：D。款冬花

解析：本题考查的是款冬花药材的性状鉴别。常单生或2～3个基部连生，苞片外表面紫红色、内表面密被白色絮状茸毛的药材是款冬花（D对）。款冬花：【性状鉴别】药材呈长圆棒状。上端较粗，下端渐细或带有短梗，外面被有多数鱼鳞状苞片，习称“连三朵”。苞片外表面紫红色或淡红色，内表面密被白色絮状茸毛。体轻，撕开后可见白色茸毛。气清香，味微苦而辛。丁香（A错）：【性状鉴别】药材略呈研棒状，长1～2cm。花冠圆球形，花瓣4，覆瓦状抱合，棕褐色至褐黄色，花瓣内为雄蕊和花柱，搓碎后可见众多黄色细粒状的花药。萼筒圆柱状，略扁，有的稍弯曲，红棕色或棕褐色，上部有4枚三角状的萼片，十字状分开。质坚实，富油性。气芳香浓烈，味辛辣、有麻舌感。红花（B错）：【性状鉴别】药材为不带子房的管状花。表面红黄色或红色。花冠筒细长，先端5裂，裂片呈狭条形；雄蕊5，花药聚合呈筒状，黄白色；柱头长圆柱形，顶端微分叉。质柔软。气微香，味微苦。槐花（C错）：【性状鉴别】药材皱缩而卷曲，花瓣多散落。完整者花萼钟状，黄绿色，先端5浅裂，花瓣5，黄色或黄白色，近圆形，先端微凹。雄蕊10，其中9个基部连合，花丝细长。雌蕊圆柱形，弯曲。体轻。气微，味微苦。金银花（E错）：【性状鉴别】药材呈棒状，上粗下细，略弯曲。表面黄白色或绿白色（贮久色渐深），密被短柔毛。偶见叶状苞片。花萼绿色，先端5裂，裂片有毛。开放者，花冠筒状，先端二唇形。气清香，味淡，微苦。